在牛奶培养基中可引起“汹涌发酵”是
A. 铜绿假单胞菌
B. 幽门螺杆菌
C. 产气荚膜梭菌
D. 金黄色葡萄球菌
E. 军团菌

正确答案：C。产气荚膜梭菌

解析：在牛奶培养基中可引起“汹涌发酵”是产气荚膜梭菌（C对）。产气荚膜梭菌代谢十分活跃，可分解多种常见的糖类，产酸产气，在牛奶培养基中能分解乳糖产酸，使其中酪蛋白凝固，同时产生大量气体（H₂和CO₂），可将凝固的酪蛋白冲成蜂窝状，将液面封固的凡士林层上推，甚至冲走试管口棉塞，气势汹涌，这个现象被称为称‘汹涌发酵’。